女，8岁。3周前曾患脓疱病，水肿。少尿、肉眼血尿3天，BP150/105mmHg。尿常规：蛋白（+），大量红细胞，管型1～2/HP。ASO升高，血沉增快，血补体C₃下降。应限制钠盐摄入直到
A. 血沉正常
B. 尿常规正常
C. 水肿消退，血压正常
D. 补体恢复正常
E. 肉眼血尿消失

正确答案：C。水肿消退，血压正常

解析：患儿，有脓疱病的感染病史，并且有血尿、蛋白尿（+）、水肿、高血压的临床表现，尿常规检查出ASO升高以及血补体C3下降，可以诊断该患儿为急性肾小球肾炎。由于急性肾小球肾炎有水肿的症状，如果不限盐饮食，会加重水肿的程度，饮食以低盐饮食为好[＜1g/d，或＜60mg/（kg·d）]，严重水肿或高血压者需无盐饮食，水肿减退可因大量利尿而使得钠盐降低，应限制钠盐摄入直到水肿消退，血压正常（C对）。